借助载体或酶系统，物质从低浓度一侧向高浓度一侧的转运方式是
A. 被动扩散
B. 主动转运
C. 促进扩散
D. 吞噬作用
E. 胞饮作用

正确答案：B。主动转运

解析：本题考查药物的转运方式。主动转运（B对）是逆浓度梯度，将物质从低浓度一侧转运到高浓度一侧的过程，需要借助载体或酶系统；被动扩散（A错）顺浓度梯度，不耗能；促进扩散（C错）是需要借助载体的被动运输；胞饮（E错）为细胞膜吞入液体的过程；吞噬（D错）指细胞摄取微粒或大分子。